下列方法中，不属于固体分散体制备方法的是
A. 熔融法
B. 溶剂-喷雾干燥法
C. 单凝聚法
D. 溶剂法
E. 研磨法

正确答案：C。单凝聚法

解析：本题考查固体分散体的制备方法。单凝聚法（C错，为本题正确答案）不属于固体分散体的制备方法。固体分散体的制备方法包括：熔融法、溶剂法、研磨法、溶剂-熔融法、溶剂-喷雾干燥法、双螺旋挤压法。